儿童龋齿随饮水氟含量减少而增加，建立病因假设的最佳推理方法选用
A. 验证法
B. 求同法
C. 求异法
D. 排除法
E. 共变法

正确答案：E。共变法